质韧，难折断，易纵向撕裂，撕裂时有粉尘飞扬；气微，味微甘的药材是
A. 桑白皮
B. 白鲜皮
C. 合欢皮
D. 海桐皮
E. 地骨皮

正确答案：A。桑白皮

解析：本题考查的是桑白皮药材的性状鉴别。质韧，难折断，易纵向撕裂，撕裂时有粉尘飞扬；气微，味微甘的药材是桑白皮（A对）。桑白皮：【性状鉴别】药材呈扭曲的卷筒状、槽状或板片状，长短宽窄不一。外表面白色或淡黄白色，较平坦，有的残留橙黄色或棕黄色鳞片状粗皮；内表面黄白色或淡黄色，有细纵纹。体轻，质韧，纤维性强，难折断，易纵向撕裂，撕裂时有粉尘飞扬。气微，味微甘。白鲜皮（B错）：【性状鉴别】药材呈卷筒状。外表面灰白色或淡灰黄色，具细纵皱纹及细根痕，常有突起的颗粒状小点；内表面类白色，有细纵纹。质脆，折断时有粉尘飞扬，断面不平坦，略呈层片状，剥去外层，迎光可见有闪烁的小亮点。有羊膻气，味微苦。合欢皮（C错）：【性状鉴别】药材呈卷曲筒状或半筒状。外表面灰棕色至灰褐色，稍有纵皱纹，有的成浅裂纹，密生明显的椭圆形横向皮孔，棕色或棕红色，偶有突起的横棱或较大的圆形枝痕，常附有地衣斑；内表面淡黄棕色或黄白色，平滑，有细密纵纹。质硬而脆，易折断，断面呈纤维性片状，淡黄棕色或黄白色。气微香，味淡、微涩、稍刺舌，而后喉头有不适感。地骨皮（E错）：【性状鉴别】药材呈筒状或槽状，外表面灰黄色至棕黄色，粗糙，有不规则纵裂纹，易成鳞片状剥落。内表面黄白色至灰黄色，较平坦，有细纵纹。体轻，质脆，易折断，断面不平坦。外层黄棕色，内层灰白色。气微，味微甘而后苦。海桐皮（D错）药材的性状鉴别，2022年考试指南未明确说明。